男性，50岁，拔除下颌第一磨牙后，新鲜血液充盈牙槽窝，但不能淹没牙根间隔，正确的处理是
A. 缝合拔牙创口
B. 咬除根间隔
C. 碘仿纱布覆盖
D. 明胶海绵覆盖
E. 任其吸收

正确答案：B。咬除根间隔

解析：本题考查牙拔除术。牙拔除术中如果牙槽间隔过高，则应用骨钳咬除（B对），否则会影响拔牙创的愈合过程。